引起弥散性血管内凝血的最常见的疾病是
A. 感染性疾病
B. 宫内死胎
C. 大面积烧伤
D. 胰腺癌
E. 器官移植

正确答案：A。感染性疾病

解析：感染性疾病（A对）引起弥散性血管内凝血所占比例为31% -43%，是最常见的疾病。宫内死胎（B错）属于妇产科疾病引起弥散性血管内凝血所占比例为4% -12%。大面积烧伤（C错）、器官移植（E错）属于创伤及手术引起弥散性血管内凝血所占比例为1% -5%。胰腺癌（D错）属于肿瘤性疾病引起弥散性血管内凝血所占比例为24% -34%。